匹配病例对照研究分为
A. 频数匹配和成组匹配
B. 频数匹配和个体匹配
C. 个体匹配和配对
D. 频数匹配和配对
E. 个体匹配和非匹配

正确答案：B。频数匹配和个体匹配

解析：本题考查匹配病例对照研究的类型。匹配病例对照研究根据匹配的方式不同，可分为频数匹配和个体匹配（B对ACDE错）两种形式。